江河水系监测的采样设定时，对大污染源所在的河段至少应设置几个采样断面
A. 1
B. 2
C. 3
D. 4
E. 5

正确答案：C。3

解析：本题考查江河水系监测的相关内容。江河水系监测的采样设定时，对大污染源所在的河段至少应设置3个（C对ABDE错）采样断面：①设在污染源的上游清洁或对照断面，可了解河水未受本地区污染时的水质状况；②设在污染源的下游的污染断面，可了解水质污染状况和程度；③设在污染断面下游一定距离的自净断面，可了解污染范围及河水的自净能力。